下颌第一前磨牙特有的解剖标志是
A. 斜嵴
B. 横嵴
C. 近中沟
D. 远中沟
E. 切嵴

正确答案：B。横嵴

解析：本题考查牙体的解剖外形。下颌第一前磨牙的特有解剖标志是横嵴（B对）。斜嵴（A错）是上颌第一磨牙的重要解剖标志，近中沟（C错）是上颌第一前磨牙的特有解剖标志，远中沟（D错）是上颌第一磨牙，下颌第一磨牙，上颌第二磨牙和下颌第二磨牙的解剖特征。切嵴（E错）是上颌中切牙和下颌中切牙的解剖标志。